具有典型Whipple三联征的疾病是
A. 胰岛素瘤
B. 胃泌素瘤
C. 肠肽瘤
D. 高血糖瘤
E. 生长抑素瘤

正确答案：A。胰岛素瘤

解析：胰岛素瘤分泌大量的胰岛素，加速全身各细胞对葡萄糖的摄取及利用，抑制糖异生，引起低血糖。临床上常表现为空腹或运动后出现低血糖症状、出现明显症状时血糖低于2.8mmol/L（50mg/dl）、进食或静脉推注葡萄糖可迅速缓解，因此将此三种表现统称为Whipple三联症（A对）。胃泌素瘤（P467）（B错）分泌促胃液素，表现为难治性消化性溃疡和腹泻，又称Zollinger-Ellison综合征。肠肽瘤（C错）（P465）分泌血管活性肠肽，表现为水样泻、低钾、低胃酸，又称Verner-Morrison综合征。高血糖瘤（P465）（D错）分泌胰高血糖素，表现为糖尿病，坏死性游走性红斑，又称糖尿病-皮炎综合征。生长抑素瘤（P465）（E错）分泌生长抑素，表现为高血糖、脂肪泻、胆结石。